男性，45岁。发现肝硬化已5年。3天前与朋友聚餐时出现呕血，鲜红色，量约1000ml.患者出现头晕心慌出冷汗等。经输血补液和应用止血药物治疗后病情好转，血压和心率恢复正常。1天前起出现睡眠障碍。并出现幻听和言语不清。化验检查示：血氨130μg/dl，血糖5.6mmol/L，尿素氮7.2mmol/L。首先考虑的治疗方案是
A. 抗生素治疗
B. 应用降氨药物
C. 胰岛素治疗
D. 血液透析治疗
E. 应用镇静药物

正确答案：B。应用降氨药物

解析：该患者考虑诊断为肝性脑病。氨中毒是肝性脑病的重要发病机制，故患者首选降氨药物（B对）降低血氨、减轻脑水肿。抗生素治疗（A错）可抑制肠道产尿素酶细菌，减少氨的生成，属于降氨药物的一种。胰岛素（C错）用于糖尿病及其并发症的治疗。血液透析（D错）用于尿毒症及中毒的治疗。应用镇静药物（E错）可诱发、加重肝性脑病。